治疗鼻病的常用穴是
A. 人中
B. 迎香
C. 地仓
D. 大迎
E. 合谷

正确答案：B。迎香

解析：迎香（B对）为手阳明大肠经穴，手、足阳明经交会穴。在鼻翼外缘中点旁，当鼻唇沟中间，主治鼻塞，鼻衄，口歪，面痒，胆道蛔虫。人中穴（A错）位于人体鼻唇沟的中点，是一个急救昏厥要穴，主治癫狂，痫，中风昏迷，小儿惊风，面肿，腰背强痛等症。地仓（C错）是足阳明胃经穴位，手足阳明经、阳脉交会穴，在面部，口角外侧，上直对瞳孔；主治口歪，流涎，眼睑动。大迎（D错）为足阳明胃经穴，主治口歪、口噤，颊肿，齿痛。合谷穴（E错）主治头痛，目赤肿痛，鼻出血，牙痛，牙关紧闭，口眼歪斜，耳聋，痄腮，咽喉肿痛，热病无汗、多汗，腹痛，便秘，经闭，滞产。